善清头目之火，治目赤肿痛，口舌生疮应选用
A. 黄连
B. 酒黄连
C. 姜黄连
D. 萸黄连
E. 黄连炭

正确答案：B。酒黄连

解析：本题考查的是黄连的炮制作用。善清头目之火，治目赤肿痛，口舌生疮应选用酒黄连（B对）。黄连：【炮制作用】黄连（A错）味苦，性寒。归心、肝、胃、大肠经。具有泻火解毒、清热燥湿的作用，用于湿热痞满，呕吐，泻痢，黄疸，高热神昏，心火亢盛，心烦不寐，血热吐衄，目赤吞酸，牙痛，消渴，痈肿疔疮；外治湿疹，湿疮，耳道流脓。①酒炙黄连能引药上行，缓其寒性，善清头目之火。②姜炙黄连（C错）其苦寒之性缓和，止呕作用增强。③吴茱萸制黄连（D错）抑制其苦寒之性，使黄连寒而不滞，以清气分湿热，散肝胆郁火为主。黄连炭（E错）的炮制作用，2022年考试指南未明确说明。